用于描述暴露因素和疾病之间的病因学联系的强弱，最合适的指标是
A. 相对危险度
B. 归因危险度
C. 归因危险度百分比
D. 发病密度
E. 人群归因危险度百分比

正确答案：A。相对危险度

解析：本题考查相对危险度。相对危险度（A对BCDE错）是指暴露组发病或死亡的危险是非暴露组的多少倍，可用于描述暴露因素和疾病之间的病因学联系的强弱。